老年慢性病患者长期服用中药应注意的事项有
A. 为增强疗效，可加大服用剂量，并坚持长期服用
B. 从小剂量开始服用
C. 辨证用药，严格掌握适应病症
D. 对体质较弱的患者不随意加药
E. 服用多种药物时，注意药物相互作用，间隔服药

正确答案：B、C、D、E。从小剂量开始服用；辨证用药，严格掌握适应病症；对体质较弱的患者不随意加药；服用多种药物时，注意药物相互作用，间隔服药

解析：本题考查的是老年人合理应用中药的原则。老年慢性病患者长期服用中药应注意的事项有从小剂量开始服用（B对）、辨证用药，严格掌握适应病症（C对）、对体质较弱的患者不随意加药（D对）与服用多种药物时，注意药物相互作用，间隔服药（E对）。老年人合理应用中药的原则：1.辨证论治，严格掌握适应证：老年人体虚多病，病情往往复杂多变，若药物使用不当可使病情急转直下，甚至无法挽救，故首先应明确是否需要进行药物治疗。对有些病证可以不用药物治疗的就不用，更不要滥用。2.熟悉药品，恰当选择应用：由于老年人的靶器官或细胞的敏感性增强，使他们对药物的反应比年轻人强烈，特别是对中枢神经抑制药物、降血糖药物、心血管系统药物反应特别敏感，在正常剂量下的不良反应增加，甚至出现药源性疾病，因此在联合用药中应高度重视。3.选择合适的用药剂量：老年人肝肾功能多有不同程度的减退或合并多器官严重疾病。因此，用药要因人而异，一般应从“最小剂量”开始。尤其对体质较弱，病情较重的患者切不可随意加药。